属于短期波动的是
A. 2017年6月台湾省某市某小学和中学共169名学生发生食物中毒
B. 我国北方地区流行性乙型脑炎发病高峰在夏秋季
C. 1965年前我国大中城市人群中麻疹每隔-年流行一次
D. 近年来，猩红热的发病率与死亡率均有明显下降
E. 细菌性痢疾多见于夏秋季

正确答案：A。2017年6月台湾省某市某小学和中学共169名学生发生食物中毒

解析：本题考查短期波动的情况。短期波动一般是指持续几天、几周或几个月的疾病流行或疫惰暴发，是疾病的特殊存在方式。短期波动一般具有比较确定的原因，多数情况下是由于大置人群同时或待续暴露于某共同致病因素，致使人群中疾病的病例数在短时间里迅速增多。如集体食堂发生食物中毒（A对BCDE错）。